女，1个月。出生体重3500g，呕吐1周。生后3周左右开始溢乳，逐日加重，呈喷射性呕吐，奶汁带凝块，不含胆汁。查体：体重3500g，皮肤轻度黄染，前囟稍凹，心肺无异常，上腹部蠕动波，右季肋下肿块，质较硬，光滑，移动。最可能的原因是
A. 先天性肥厚性幽门梗阻
B. 先天性肠扭转不良
C. 先天性巨结肠
D. 胃扭转
E. 十二指肠瘀滞症

正确答案：A。先天性肥厚性幽门梗阻

解析：先天性肥厚性幽门梗阻典型症状和体征为无胆汁的喷射性呕吐，胃蠕动波和右上肿块（A对）；胃扭转生后数周内出现呕吐，移动体位时呕吐加剧（D错）；肠扭转不良时，钡剂灌肠可显示出结肠框及回盲部充满钡剂（B错）；先天性巨结肠（C错）：胎便排除延缓、顽固性便秘和腹胀；呕吐，营养不良和发育迟缓；直肠指检和壶腹部空虚。